芦根、淡竹叶的共同功效，除清热除烦外，还有
A. 利尿
B. 止呕
C. 生津
D. 排脓
E. 凉血

正确答案：A。利尿

解析：该题考查芦根、淡竹叶的功效，属记忆内容。芦根，味甘，性寒；入肺、胃经；具有清热泻火，生津止渴，除烦，止呕，利尿的功效；淡竹叶味甘、淡，性寒；入心、胃、小肠经；具有清热泻火，除烦，利尿的功效，二者共同功效有清热泻火，除烦，利尿（A对BCDE错）。